单室模型的药物恒速静点6.64个半衰期达稳态时，达坪分数fss等于
A. 0.5
B. 0.75
C. 0.9
D. 0.95
E. 0.99

正确答案：E。0.99

解析：本题考查单室模型静脉滴注给药。单室模型的药物恒速静点6.64个半衰期达稳态时，达坪分数fss等于0.99（E对），静脉滴注给药达到稳态血药浓度的百分数与半衰期之间的关系式为：n=-3.32lg（1-fss），代入n=6.64，fss为99%。